下列不属于健康管理策略的是
A. 生活方式管理
B. 需求管理
C. 疾病管理
D. 残疾管理
E. 意外伤害管理

正确答案：E。意外伤害管理

解析：本题考查健康管理策略。健康管理策略包括：①生活方式管理（A对）；②需求管理（B对）；③疾病管理（C对）；④灾难性疾病管理；⑤残疾管理（D对）；⑥综合人群健康管理。意外伤害管理（E错，为本题正确答案）不属于健康管理策略。